薄层色谱系统适用性试验的内容有
A. 检测灵敏度
B. 精密度
C. 比移值
D. 拖尾因子
E. 分离效能

正确答案：A、C、E。检测灵敏度；比移值；分离效能